患者，男，40岁。乙肝病史10年，近2个月来右上腹胀痛加重，检查：面部有蜘蛛痣，右上腹压痛，肝肋缘下3cm，质硬，ALT40U/L，HBsAg（+），AFP：500μg/L。应首先考虑的是
A. 慢性乙肝活动期
B. 乙肝合并肝硬化
C. 乙肝合并胆囊炎
D. 原发性肝癌
E. 继发性肝癌

正确答案：D。原发性肝癌

解析：患者中年男性，乙肝病史，面部有蜘蛛痣，HbsAg阳性，提示肝脏病变，且AFP500μg/L，考虑原发性肝癌（D对）。慢性乙肝活动期（A错）、乙肝合并肝硬化（B错）、乙肝合并胆囊炎（C错）AFP不会超过400。患者无其他部位肿瘤病史，故不会是继发性肝癌（E错）。